临床常用于确定牙髓的死、活的方法是
A. 视诊
B. 光纤投照
C. 温度测试
D. 电活力测试
E. 穿髓孔探诊

正确答案：D。电活力测试

解析：牙髓坏死因各种原因导致牙髓组织坏死，失去正常结构，失去牙髓活力，临床检查主要表现为电活力测试无反应。掌握“牙髓坏死、牙髓钙化与牙内吸收”知识点。